文化可以逐代传递，指的是文化的
A. 历史性
B. 现实性
C. 渗透性
D. 继承性
E. 社会性

正确答案：D。继承性